氧化还原法中常用的滴定液是
A. 碘滴定液
B. 硫酸铈滴定液
C. 锌滴定液
D. 草酸滴定液
E. 硝酸银滴定液

正确答案：A、B。碘滴定液；硫酸铈滴定液

解析：本题考查氧化还原法。氧化还原法中常用的滴定液是：碘滴定液（A对）、硫酸铈滴定液（B对）。氧化还原滴定法是以溶液中氧化剂和还原剂之间的电子转移为基础的一种滴定分析方法，包括铈量法、碘量法、溴量法、溴酸钾法、重铬酸钾法、高锰酸钾法及亚硝酸钠法等。碘滴定液为碘量法所用；硫酸铈滴定液为铈量法所用。锌滴定液（C错）为络合滴定法中EDTA滴定液的反滴定剂。草酸滴定液（D错）与高锰酸钾滴定液配合使用。硝酸银滴定液（E错）为沉淀滴定法所用。